有关眼膏剂的不正确表述是
A. 应无刺激性、过敏性
B. 应均匀、细腻、易于涂布
C. 必须在清洁、灭菌的环境下制备
D. 常用基质中不含羊毛脂
E. 成品不得检验出金黄色葡萄球菌和绿脓杆菌

正确答案：D。常用基质中不含羊毛脂